以下疾病最常出现尿白细胞管型的是
A. 急性肾盂肾炎
B. 微小病变型肾病
C. IgA肾病
D. 急性肾小管坏死
E. 急性肾小球肾炎

正确答案：A。急性肾盂肾炎

解析：最常出现尿白细胞管型的是急性肾盂肾炎（A对）。肾盂肾炎起病急，有发热、寒战和白细胞增多等症状，常伴尿频、尿急、尿痛，并有腰部酸痛及肾区叩痛。尿检查显示蛋白尿、管型尿、血尿等，白细胞管型对肾盂肾炎的临床诊断有意义。微小病变型肾病（B错）最早常出现水肿，蛋白尿多为选择性，电镜下脏层上皮细胞足突消失为主要诊断依据（P270）。IgA肾病（C错）临床表现通常为反复镜下或肉眼血尿，可伴有轻度蛋白尿，电镜检查显示系膜区有电子致密沉积物（P272）。急性肾小管坏死（D错）是急肾衰最常见的类型，先驱症状可在数小时或1～2天后出现典型的急性肾衰表现。急性肾小球肾炎（E错）主要表现为急性肾炎综合征。常见血尿、水肿和轻到中度高血压，尿中可出现各种管型可有轻度蛋白尿（P266）。